根据《药品管理法》等法律法规的要求，下列关于个人自用少量药品的进出境管理的说法，错误的有
A. 未经批准进口少量境外已合法上市销售的药品，可以免于处罚
B. 在个人药品进出境过程中，应当携带三级以上医疗机构出具的医疗诊断证明和有效医师处方原件，以证明其确因身体需要携带治疗药品，同时也便于确定所携带药品的合理数量
C. 进出境人员随身携带的个人自用的少量药品，应当以自用、合理数量为限并接受口岸药品监督管理部门监管
D. 进出境人员不得携带任何药品类易制毒化学品药品制剂

正确答案：A、B、C、D。未经批准进口少量境外已合法上市销售的药品，可以免于处罚；在个人药品进出境过程中，应当携带三级以上医疗机构出具的医疗诊断证明和有效医师处方原件，以证明其确因身体需要携带治疗药品，同时也便于确定所携带药品的合理数量；进出境人员随身携带的个人自用的少量药品，应当以自用、合理数量为限并接受口岸药品监督管理部门监管；进出境人员不得携带任何药品类易制毒化学品药品制剂

解析：本题考查的是个人自用少量药品的进出境管理。根据《药品管理法》的规定，未经批准进口少量境外已合法上市的药品，且情节较轻的，可以依法减轻或免于处罚（A错，为本题正确答案）；在个人药品进出境过程中，应尽量携带好正规医疗机构出具的医疗诊断书，以证明其确因身体需要携带，方便海关凭医生有效处方原件确定携带药品的合理数量（B错，为本题正确答案）；进出境人员随身携带的个人自用的少量药品，应当以自用、合理数量为限，并接受海关监管（C错，为本题正确答案）；进出境人员随身携带第一类中的药品类易制毒化学品药品制剂和高锰酸钾，应当以自用且数量合理为限，并接受海关监管（D错，为本题正确答案）。个人自用少量药品的进出境管理：进出境人员随身携带的个人自用的少量药品，应当以自用、合理数量为限，并接受海关监管。进出境人员随身携带第一类中的药品类易制毒化学品药品制剂和高锰酸钾，应当以自用且数量合理为限，并接受海关监管；进出境人员不得随身携带前款规定以外的易制毒化学品。在个人药品进出境过程中，应尽量携带好正规医疗机构出具的医疗诊断书，以证明其确因身体需要携带，方便海关凭医生有效处方原件确定携带药品的合理数量。除医生专门注明理由外，处方一般不得超过7日用量；麻醉药品与第一类精神药品注射剂处方为1次用量，其他剂型一般不超过3日用量。超过自用合理数量范围的药品应通过货物渠道进行报关处置。根据《药品管理法》的规定，未经批准进口少量境外已合法上市的药品，且情节较轻的，可以依法减轻或免于处罚。